据报道：现在有些医院已采取了一些隔离措施，使体格检查置于一个相对封闭的环境中，以免受检病人曝光于众人面前。更确切地说这些措施反映了医院和医生哪一种医德意识
A. 服务意识
B. 管理意识
C. 保护病人隐私意识
D. 有利于病人的意识
E. 热爱医学事业的意识

正确答案：C。保护病人隐私意识

解析：患者为了诊治的需要，有权维护自己的隐私不受侵害。掌握“医患关系伦理”知识点。